男，65岁。间断腹痛伴呕吐、乏力、少尿6小时，呕吐量大，无口渴。5年前行“急性重症胰腺炎腹腔引流术”。此时患者最可能的水电解质平衡紊乱是
A. 等渗性缺水
B. 高渗性缺水
C. 低渗性缺水
D. 高钾血症
E. 稀释性低钠血症

正确答案：A。等渗性缺水

解析：老年男性，间断腹痛，大量呕吐6小时， 最可能发生等渗性缺水（A对），因为急性病因常常导致等渗性缺水。高渗性脱水（B错）典型的表现为口渴。低渗性缺水（C错）大量消化液丢失而只补充水，这是最常见原因。如大量呕吐、长期胃肠减压引流导致大量含Na⁺消化液丢失而只补充水或仅输注葡萄糖溶液，而患者大量呕吐后无补液史可排除。呕吐，胃酸丢失，易导致低钾低氯性代谢性碱中毒（D错）。病人大量呕吐，体液丢失，不可能导致稀释性低钠血症（E错）。